45岁男性，经理，送来急诊，自述半小时前突然感到气紧，胸闷，心悸，头晕，出汗，认为生命垂危，要求紧急处理。近一月来，这种情况发生过3次，每次持续约0.5～1小时，发病间隙期一切正常，发病与饮食无明显关系。最大可能的诊断是
A. 癔症发作
B. 低血钾症
C. 惊恐发作
D. 心肌梗塞
E. 内脏性癫痫

正确答案：C。惊恐发作

解析：该病例患者突然感到气紧以及认为生命垂危（惊恐发作表现），发作时有胸闷、心悸、头晕，出汗（自主神经症状），近一月来，反复发作，持续时间0.5-1小时（一个月之内存在数次惊恐发作，发作时间一般数分钟至数十分钟），故诊断为惊恐发作（C对）。心肌梗塞和惊恐发作均可表现为胸闷、心悸，但本例无明显诱因（过重的体力劳动），无高血压高血脂等高危因素，故患心肌梗塞的可能性较小（D错），为进一步明确诊断，需借助心电图和心肌酶学检查进行排查。内脏性癫痫（腹型癫痫综合征）以腹痛为主要特征，多见于儿童，与本例不符（E错）。